患者男，23岁，建筑工人。因牙关紧闭前来就诊。工友叙述上周被生锈铁定刺伤足部，而后出现发热，头痛头晕，全身乏力。检查颈项强直，张口受限，苦笑面容，足底伤口细小且深，伤口周围皮肤红肿并化脓。初步断定此患者为
A. 狂犬病
B. 流行性脑炎
C. 梅毒
D. 破伤风
E. 放线菌病

正确答案：D。破伤风

解析：生锈铁钉刺穿伤口，凡外伤以后出现紧张、扯痛、张口困难、颈部发硬、反射亢进等，均应考虑破伤风。且破伤风最先受到影响的肌群是咀嚼肌，会发生张口困难，“苦笑面容”，角弓反张等表现。掌握“特殊性感染”知识点。